崩漏虚热证的治法是
A. 滋阴清热，止血调经
B. 清热凉血，止血调经
C. 温肾固冲，止血调经
D. 滋水益阴，止血调经
E. 益气摄血，养血调经

正确答案：A。滋阴清热，止血调经

解析：阴虚内热，热扰冲任血海，迫血妄行，发为崩漏，治当滋阴清热，止血调经（A对）。实热内蕴，损伤冲任，血海沸溢，迫血妄行，发为崩漏，治当清热凉血，止血调经（B错）。肾阳虚衰，阳不摄阴，封藏失司，发为崩漏，治当温肾固冲，止血调经（C错）。肾水阴虚，冲任失守，致经乱无期，治疗当滋水益阴，止血调经（D错）。脾气亏虚，中气虚弱甚或下陷，冲任不固，血失统摄，发为崩漏，治当补气摄血，养血调经（E错）。